关于动脉血PaCO₂,论述不正确的是
A. 平均值40mmHg
B. 血浆中物理状态溶解的CO₂分子产生的张力
C. 是反映呼吸因素的重要指标
D. 数值降低说明肺泡通气不足
E. 其原发性改变可引起呼吸性酸碱平衡紊乱

正确答案：D。数值降低说明肺泡通气不足

解析：动脉血CO₂是血浆中物理状态溶解的CO₂分子产生的张力（B对），由于CO₂通过呼吸膜弥散快，动脉血 CO₂分压(PaCO₂)相当于肺泡气CO₂分压(PaCO₂)，故PaCO₂与肺泡通气量成反比，数值升高说明肺泡通气不足（D错，为本题正确答案），因此PaCO₂是反映呼吸因素的重要指标（C对），其原发性改变可引起呼吸性酸碱平衡紊乱（E对），平均值为40mmHg（A对）。